对药品生产许可证有效期届满未重新发证的，应当
A. 不予核发药品生产许可证
B. 注销药品生产许可证
C. 补发药品生产许可证
D. 不予再注册

正确答案：B。注销药品生产许可证

解析：本题考查的是药品生产许可证管理。对药品生产许可证有效期届满未重新发证的，应当注销药品生产许可证（B对）。注销药品生产许可证：有下列情形之一的，药品生产许可证由原发证机关注销，并予以公告：①主动申请注销药品生产许可证的；②药品生产许可证有效期届满未重新发证的；③营业执照依法被吊销或者注销的；④药品生产许可证依法被吊销或者撤销的；⑤法律、法规规定应当注销行政许可的其他情形。补发药品生产许可证（C错）：药品生产许可证遗失的，药品上市许可持有人、药品生产企业应当向原发证机关申请补发，原发证机关按照原核准事项十日内补发药品生产许可证。许可证编号、有效期等与原许可证一致。有下列情形之一的，不予再注册（D错）：①有效期届满前未提出再注册申请的；②药品注册证书有效期内持有人不能履行持续考察药品质量、疗效和不良反应责任的；③未在规定时限内完成药品批准证明文件和药品监督管理部门要求的研究工作且无合理理由的；④经上市后评价，属于疗效不确切、不良反应大或者因其他原因危害人体健康的；⑤法律、行政法规规定的其他不予再注册情形。对不予再注册的药品，药品注册证书有效期届满时予以注销。